以下关于口腔黑色素瘤的描述错误的是
A. 可分为原位和呈侵袭性生长期
B. 口腔黑色素瘤可分为原位、侵袭性和混合型三类
C. 非典型黑色素细胞病变可以进展成恶性黑色素瘤
D. Pagetoid侵犯最为严重
E. 交界性病损可以定位非典型性黑色素细胞增生

正确答案：D。Pagetoid侵犯最为严重

解析：口腔黑色素瘤可分为原位和呈侵袭性生长期，与皮肤的肢端雀斑样黑色素瘤相似，具有交界活性，向表面侵犯，但Pagetoid侵犯不常见。非典型黑色素细胞病变可以进展成恶性黑色素瘤，但没有口腔黏膜良性色素痣发展成侵袭性恶性黑色素瘤的证据。因此，口腔黑色素瘤可分为原位、侵袭性和混合型三类。交界性病损可以定为非典型性黑色素细胞增生。掌握“恶性黑色素瘤”知识点。